异丙肾上腺素
A. 选择性激动β₁受体
B. 选择激动β₂受体
C. 对两种受体均有作用
D. 对两种受体均无作用

正确答案：C。对两种受体均有作用